右侧视神经损伤可出现
A. 右眼间接对光反射消失
B. 右眼直接对光反射存在
C. 右眼直接对光反射消失
D. 左眼间接对光反射存在
E. 右眼直接和间接对光反射均消失

正确答案：E。右眼直接和间接对光反射均消失

解析：瞳孔对光反射在临床上有重要意义，反射消失，可能预示病危。但视神经或动眼神经受损，也能引起瞳孔对光反射的变化。一侧视神经受损时，信息传入中断，光照患侧眼的瞳孔，两侧瞳孔均不反应，所以右侧视神经损伤会出现右眼直接和间接对光反射均消失（E对）。